以下药物服用后不宜立即大量饮水的是
A. 二羟丙茶碱
B. 硫糖铝
C. 磺胺甲基异噁唑
D. 阿伦膦酸钠
E. 普鲁卡因胺

正确答案：B。硫糖铝

解析：本题考查服用后不宜立即大量饮水的药物。硫糖铝（B对）为胃黏膜保护剂，服药后在胃中形成保护膜，服药后1小时内尽量不要饮水，避免保护层被水冲掉。